关于新生儿病理性黄疸的叙述，不正确的是
A. 血清结合胆红素<25.7µmol/L（1.5mg/dL）
B. 血清胆红素上升速度快
C. 黄疸退而复现
D. 黄疸持续时间>2周
E. 黄疸常在生后24小时内出现

正确答案：A。血清结合胆红素<25.7µmol/L（1.5mg/dL）

解析：病理性黄疸，又称为非生理性高胆红素血症，病理性黄疽相对生理性黄疸而言是血清胆红素水平异常增高或胆红素增高性质的改变。可有血清结合胆红素>34μmol/L（2mg/dL）（A错，为本题正确答案），血清胆红素上升速度快；黄疸常在生后24小时内（生理性黄疸为24h以外）出现，持续时间长（＞2周，生理性黄疸＜2周），退而复现等临床表现。